下列除哪项外均为积聚的发病原因
A. 情志失调
B. 感受寒湿
C. 饮食所伤
D. 他病转移
E. 外感湿热

正确答案：E。外感湿热

解析：积聚的发生是病理因素持续作用的结果，而外感湿热表达的是一种短暂的邪气侵袭，这种情况一般不会导致积聚的发生（E对）。积聚的发病病因包括情志失调、饮食所伤、他病转移（他病续发）、外邪侵袭（ABCD错）。